肾经与膀胱经的交接部位在
A. 足小趾端
B. 足大趾内端
C. 食指端
D. 手小指端
E. 心胸部

正确答案：A。足小趾端

解析：足少阴肾经和足太阳膀胱经在足小趾端交接（A对）。足阳明胃经和足太阴脾经在足大趾内端交接（B错）。手太阴肺经和手阳明大肠经在食指端交接（C错）。手少阴心经和手手太阳小肠经在手小指端交接（D错）。足太阴脾经和手少阴心经在心中交接（E错）。